下列各项，易阻遏气机的外邪是
A. 风邪
B. 火邪
C. 湿邪
D. 寒邪
E. 暑邪

正确答案：C。湿邪

解析：本题主要考查六淫各自的性质和致病特征。湿为阴邪，易损伤阳气，阻遏气机（C对）；湿性重浊、黏滞；湿性趋下，易袭阴位。风为阳邪，轻扬开泄，易袭阳位；风性善行而数变；风性主动；风为百病之长（A错）。火热为阳邪，其性燔灼趋上；易扰心神；易伤津耗气；易生风动血；易致疮痈（B错）。寒为阴邪，易伤阳气；寒性凝滞；寒性收引（D错）。暑为阳邪，其性炎热； 暑性升散，扰神伤津耗气；暑多挟湿（E错）。